下列疾病中，属于左旋多巴适应症的是
A. 消化道溃疡
B. 高血压
C. 糖尿病
D. 精神病
E. 肝昏迷

正确答案：E。肝昏迷